73岁，多年高血压，糖尿病病史，主动脉瓣第二听诊区可闻及舒张期吹风样递减型杂音，瓣膜病应为
A. 退行性
B. 风湿性
C. 先天性
D. 感染性
E. 自身免疫性

正确答案：A。退行性

解析：患者73岁，多年高血压，糖尿病病史，主动脉瓣第二听诊区可闻及舒张期吹风样递减型杂音，考虑该瓣膜病为慢性主动脉瓣关闭不全，因患者高龄，考虑退行性病变（A对）导致瓣叶钙化常为慢性主动脉瓣关闭不全的病因。因患者高龄，合并高血压糖尿病史，闻及主动脉瓣关闭不全杂音，故风湿性心脏病（B错）、先天性畸形（C错）、感染性心内膜炎（D错）、自身免疫性（E错）均不符合。感染性心内膜炎（D错）常为急性主动瓣关闭不全最常见的原因。